龋的进程多缓慢、持续，又被称为干性龋的是
A. 急性龋
B. 平滑面龋
C. 慢性龋
D. 浅龋
E. 隐匿性龋

正确答案：C。慢性龋

解析：慢性龋：龋的进程多缓慢、持续，又称干性龋。掌握“龋病的临床表现与分类”知识点。